与自发性蛛网膜下腔出血发病最不相关的因素是
A. 脑血管畸形范围
B. 性别
C. 血压上升的程度
D. 颅内压力的变化
E. 动脉瘤的大小

正确答案：B。性别

解析：蛛网膜下腔出血分为外伤性和自发性两种情况，自发性又分为原发性和继发性两种类型。原发性蛛网膜下腔出血主要见于动脉瘤性蛛网膜下腔出血，常见原因有颅内动脉瘤和血管畸形，还可见于高血压、动脉粥样硬化所致梭形动脉瘤及感染所致的真菌性动脉瘤等血管畸形。脑血管畸形范围（A对）、血压上升程度（C对）、颅内压变化（D对）、动脉瘤大小（E对）均于自发性蛛网膜下腔出血有关联。脑血管畸形范围越广，血管壁越薄，越易导致蛛网膜下腔出血；血压上升程度越高，越易导致颅内的动脉瘤破裂；颅内压变化越剧烈，越易导致颅内的动脉瘤破裂；动脉瘤越大，越易破裂。性别（B错，为本题正确答案）与自发性蛛网膜下腔出血因素无明显关系，与性别因素相关的脑血管疾病最常见于脑卒中。